连续把物料供给粉碎机并不断地从粉碎机中取出细粉的方法属于
A. 闭塞粉碎
B. 开路粉碎
C. 湿法粉碎
D. 低温粉碎
E. 混合粉碎

正确答案：B。开路粉碎